女性，25岁。午后发热3周，咳嗽，咳少量白色黏痰。体检：左肩胛区闻及少量湿罗音，血沉40mm/h，白细胞10x10⁹/L，中性粒细胞0.75，胸片示左第二前肋斑片状浸润阴影。最可能的诊断是
A. 肺炎链球菌肺炎
B. 浸润型肺结核
C. 肿瘤肺内浸润
D. 支原体肺炎
E. 肺真菌病

正确答案：B。浸润型肺结核